乳牙拔除的禁忌证
A. 血液病
B. 内分泌疾病
C. 严重心功能不全
D. 根尖周有急性炎症
E. 以上均是

正确答案：E。以上均是

解析：本题考查乳牙拔除的禁忌证。乳牙拔除，指拔除因生理性替换以及严重的牙体疾病或牙外伤等不能设法保留的乳牙。并非所有不能保留的乳牙均可以拔除，乳牙拔除尚需考虑以下禁忌证：1.全身情况（1）患血液疾病 （A对）：如血液病、贫血、血小板减少症等血液病的活动期。（2）患内分泌疾病（B对）：患有艾迪生病、甲亢以及糖尿病，拔牙后创口不易止血。（3）患心脏、肾脏等疾病：有严重代谢障碍的心脏病患者（C对），严禁拔牙。（4）急性感染、发热时也应避免拔牙。2.局部因素（1）虽为病灶牙，但局部根尖周组织和牙槽骨有急性化脓性炎症（D对）时，应在药物控制后再拔除，以免炎症扩散。（2）同时伴有急性广泛性牙龈炎或严重的口腔黏膜病时，应消炎、控制症状后再拔牙。（ABCD均对，E为本题的正确答案）。